哪项不是职业性肿瘤的特点
A. 接触明确的致癌因素
B. 潜伏期长、发病年龄早
C. 有一定好发部位
D. 有一定的发病条件
E. 多数毒物的毒性作用不存在阈值或阈剂量

正确答案：E。多数毒物的毒性作用不存在阈值或阈剂量